含缬氨酸结构的前体药物是
A. 更昔洛韦
B. 盐酸伐昔洛韦
C. 阿昔洛韦
D. 泛昔洛韦
E. 阿德福韦酯

正确答案：B。盐酸伐昔洛韦

解析：本题考查伐昔洛韦的化学结构。伐昔洛韦（B对）是将阿昔洛韦用L-缬氨酸酯化得到的药物。伐昔洛韦进入体内后经酶水解得到阿昔洛韦，再经磷酸化为三磷酸阿昔洛韦发挥抗病毒作用。